有关气雾剂中药物吸收影响向因素的叙述，正确的有
A. 吸入给药时，药物的吸收速度与药物的脂溶性成反比
B. 发挥全身作用的吸人气雾剂，雾滴的粒径愈小愈好
C. 发挥全身作用的吸人气雾剂，雾滴的粒径一般以0.5～1μm为宜
D. 起局部治疗作用的吸入气雾剂，雾滴的粒径一般以3～10μm为宜
E. 吸入给药时，药物的吸收速度与药物的分子大小成反比

正确答案：C、D、E。发挥全身作用的吸人气雾剂，雾滴的粒径一般以0.5～1μm为宜；起局部治疗作用的吸入气雾剂，雾滴的粒径一般以3～10μm为宜；吸入给药时，药物的吸收速度与药物的分子大小成反比